以下关于三叉神经痛的叙述，哪项是错误的
A. 三叉神经痛分为原发性继发性两种
B. 疼痛可自发，也可由刺激“扳机点”引起
C. 原发性三叉神经痛病员无论病程长短，神经系统检查极少有阳性体征
D. 角膜反射的改变常提示器质性三叉神经痛
E. 目前治疗三叉神经痛的首选药物是苯妥英钠

正确答案：E。目前治疗三叉神经痛的首选药物是苯妥英钠

解析：本题考查三叉神经痛。卡马西平：或称痛痉宁或酰胺咪嗪，是目前治疗三叉神经痛的首选药物（E错，为本题正确答案）。